孕妇及体虚者慎用的药是
A. 川贝止咳露
B. 百合固金丸
C. 蛇胆川贝液
D. 雪梨膏
E. 芒果止咳片

正确答案：C。蛇胆川贝液

解析：本题考查的是蛇胆川贝散的注意事项。孕妇及体虚者慎用的药是蛇胆川贝液（C对）。蛇胆川贝散：【注意事项】孕妇慎用。痰湿犯肺或久咳不止者慎用。服药期间，忌食辛辣、油腻食物，忌吸烟、饮酒。川贝止咳露（A错）：【注意事项】风寒咳嗽者慎用。服药期间，忌烟、酒及辛辣食物。百合固金丸（B错）、雪梨膏（D错）与芒果止咳片（E错）的注意事项，2022年考试指南未明确说明。